先祛邪后扶正的治疗原则，适用于
A. 正虚无邪的病证
B. 正虚兼邪的病证
C. 邪盛正不虚的病证
D. 邪盛正虚能耐攻的病证
E. 邪盛正虚不能耐攻的病证

正确答案：D。邪盛正虚能耐攻的病证

解析：本题考查的是祛邪扶正的治则。先祛邪后扶正的治疗原则，适用于邪盛正虚能耐攻的病证（D对）。扶正祛邪的运用：运用扶正祛邪治则时，要认真细致地观察和分析正邪两方消长盛衰的情况，并根据正邪在矛盾斗争中的地位，决定扶正与祛邪的主次和先后。1.扶正：扶正适用于以正气虚为主要矛盾，而邪气也不盛的虚性病证（A错）。如补法，包括补气、助阳、滋阴、养血等，为扶正治则指导下的具体治法。2.祛邪：祛邪适用于以邪实为主要矛盾，而正气未衰的实性病证（C错）。如汗法、吐法、下法、清法、消法等，皆属祛邪治则指导下的具体治法。3.扶正与祛邪兼用：扶正与祛邪兼用又称“攻补兼施”，适用于正虚邪实病证（B错），两者同时兼用，则扶正不留邪，祛邪又不会伤正。在具体应用时，还要分清以正虚为主，还是以邪实为主。正虚较急重的，应以扶正为主，兼顾祛邪；而邪实较急重的，则以祛邪为主，兼顾扶正。4.先祛邪后扶正：先祛邪后扶正适用于虽为邪盛正虚，但正气尚能耐攻，或同时兼顾扶正反会助邪的病证。如瘀血所致的崩漏证，瘀血不去，则崩漏难止，故应先用活血祛瘀法，然后补血。5.先扶正后祛邪：先扶正后祛邪适用正虚邪实，以正虚为主的病证（E错）。因正气过于虚弱，若兼以攻邪，则反而更伤正气，故应先扶正而后祛邪。如某些虫积患者，因正气太虚弱，不宜驱虫，应先健脾以扶正，使正气得到一定恢复之时，然后再驱虫消积。